颊（颊长）神经阻滞麻醉区域是
A. 同侧下颌第二前磨牙及磨牙颊侧牙龈、黏骨膜、颊部黏膜、颊肌和皮肤
B. 同侧下颌前磨牙及磨牙颊侧牙龈、黏骨膜、颊部黏膜、颊肌和皮肤
C. 同侧下颌第一前磨牙颊侧牙龈、黏骨膜、颊部黏膜、颊肌和皮肤
D. 同侧下颌第一、二前磨牙颊侧牙龈、黏骨膜、颊部黏膜、颊肌和皮肤
E. 同侧下颌前牙颊侧牙龈、黏骨膜、颊部黏膜、颊肌和皮肤

正确答案：A。同侧下颌第二前磨牙及磨牙颊侧牙龈、黏骨膜、颊部黏膜、颊肌和皮肤

解析：颊（颊长）神经阻滞麻醉区域及效果：同侧下颌第二前磨牙及磨牙颊侧牙龈、黏骨膜、颊部黏膜、颊肌和皮肤。局部可有肿胀、麻木感。掌握“颌面部常用局麻法及牙拔除的麻醉选择”知识点。